分布在邻近牙骨质的牙周膜中，能够形成类牙骨质的细胞为
A. 成纤维细胞
B. 牙周膜干细胞
C. 成牙骨质细胞
D. Malassez上皮剩余
E. 成骨细胞

正确答案：C。成牙骨质细胞

解析：成牙骨质细胞：分布在邻近牙骨质的牙周膜中，细胞扁平，其功能是合成牙骨质，新形成的且未钙化的牙骨质称为类牙骨质。掌握“牙周膜”知识点。